常用于检查血液和组织中的梅毒螺旋体的染色方法是
A. 革兰染色法
B. 抗酸染色法
C. 墨汁染色法
D. 镀银染色法
E. 鞭毛染色法

正确答案：D。镀银染色法